下列关于胆汁的描述，正确的是
A. 非消化期无胆汁分泌
B. 消化期只有胆囊胆汁排入小肠
C. 胆汁中含有脂肪消化酶
D. 胆汁中与消化有关的成分是胆盐
E. 胆盐可促进蛋白的消化和吸收

正确答案：D。胆汁中与消化有关的成分是胆盐

解析：胆汁中最重要的成分是胆盐，可以作为乳化剂乳化脂肪，从而促进脂肪的消化和吸收（D对）。非消化期，肝脏分泌的胆汁主要储存于胆囊内（A错）；在消化期，食物及消化液可刺激胆囊的收缩，将储存于胆囊内的胆汁排入十二指肠，肝脏也可直接分泌胆汁排入十二指肠（B错）。胆汁中不含消化酶（C错）。蛋白质的消化吸收主要由胰液完成，胆盐主要促进脂肪和脂溶性维生素的吸收（E错）。